各型痹证的共同特点是
A. 关节疼痛、麻木
B. 肢体酸楚、重着
C. 不同程度的疼痛伴随活动障碍
D. 关节疼痛呈现游走性
E. 肢体、关节疼痛、酸楚

正确答案：C。不同程度的疼痛伴随活动障碍

解析：痹症指因各种邪气闭阻关节，而导致经脉不通，经筋失养，从而出现不同程度的疼痛和活动障碍（C对），因感受邪气不同而表现各异。关节疼痛、麻木（A错），是痛痹的典型表现；肢体酸楚、重着（B错），是着痹的典型表现；关节疼痛呈现游走性（D错），是行痹的典型表现；肢体、关节疼痛、酸楚（E错），是着痹的典型表现。